切断下述哪条纤维束可引起痛、温觉消失
A. 内侧纵束
B. 外侧丘系
C. 脊髓丘脑束
D. 薄束和楔束
E. 脊髓小脑前后束

正确答案：C。脊髓丘脑束

解析：内侧纵束（A错）的主要功能为协调眼外肌之间的运动，调节眼球的慢速运动和头部的姿势。。一侧外侧丘系（B错）传导双侧耳的听觉冲动。脊髓丘脑束（C对）递对侧躯干、四肢的痛、温觉和粗略触压觉，损伤后可引起痛、温觉消失。薄束和楔束（D错）传导同侧躯干及上下肢的肌、腿、关节的本体感觉（位置觉、运动觉和震动觉）和皮肤的精细触觉（如通过触摸辨别物体纹理粗细和两点距离）信息。脊髓小脑前后束（E错）传递下肢和躯干下部的非意识性本体感觉和触、压觉信息。